抗菌药物是病原微生物所致感染性疾病病原的药物，不包括
A. 结核病
B. 支原体
C. 螺旋体
D. 立克次体
E. 真菌

正确答案：A。结核病

解析：抗菌药物，是指治疗细菌、支原体、衣原体、立克次体、螺旋体、真菌等病原微生物所致感染性疾病病原的药物，不包括治疗结核病、寄生虫病和各种病毒所致感染性疾病的药物以及具有抗菌作用的中药制剂。掌握“抗菌药物临床应用概述及管理”知识点。